巴豆的原植物属于
A. 豆科
B. 木兰科
C. 大戟科
D. 蔷薇科
E. 樟科

正确答案：C。大戟科

解析：本题考查的是巴豆的来源。巴豆的原植物属于大戟科（C对）。巴豆：【来源】为大戟科植物巴豆的干燥成熟果实。来源于豆科（A错）的中药有葛根、甘草、黄芪、鸡血藤、降香、合欢皮、番泻叶、槐花等。来源于木兰科（B错）的中药有厚朴、辛夷、五味子、南五味子等。原植物属于豆科的有沙苑子、决明子、补骨脂。来源于蔷薇科（D错）的中药有地榆、枇杷叶、木瓜、山楂、苦杏仁、桃仁、乌梅、金樱子等。来源于樟科（E错）的中药有肉桂、天然冰片等。